与崩漏的发生密切相关的经脉是
A. 肝经肾经
B. 肝经脾经
C. 任脉带脉
D. 任脉冲脉
E. 任脉督脉

正确答案：D。任脉冲脉

解析：崩漏的病位在胞宫，与冲、任二脉及脾、肾关系密切。任脉主要病候为脏腑病、妇科病、前阴病、颈及面口病、神志病、虚证。冲脉主要病候为月经失调、不孕等妇科病证及腹痛里急、气逆上冲（D对）。肝经主治概要为肝胆病、妇科病、经脉循行部位的其他病证。肾经主治概要为头和五官病证、前阴病、妇科病、经脉循行部位的其他病证（A错）。脾经主治概要为脾胄病、妇科病、前阴病、经脉循行部位的其他病证（B错）。带脉主要病候为妇科经带病证，腹满，腹腰拘急疼痛，痿证（C错）。督脉主治概要为脏腑病、神志病、头面五官病 、经脉循行部位的其他病证（E错）。